气管向患侧移位，可见于
A. 胸腔积液
B. 气胸
C. 肺气肿
D. 肺不张
E. 肺实变

正确答案：D。肺不张

解析：使气管移向患侧的疾病有肺不张（D对）、肺硬化、胸膜粘连。胸腔积液（A错）、气胸（B错）、肺气肿（C错）、肺实变（E错）等疾病时，气管向健侧移位。